金匮肾气丸是
A. 含乌头类药物的中成药
B. 含生天南星的中成药
C. 含马钱子的中成药
D. 含蟾酥的中成药
E. 含生半夏的中成药

正确答案：A。含乌头类药物的中成药

解析：本题考查的是含乌头类药物的中成药。金匮肾气丸是含乌头类药物的中成药（A对）。含乌头类药物的中成药：追风丸、追风透骨丸、三七伤药片、附子理中丸、金匮肾气丸、木瓜丸、小金丸、风湿骨痛胶囊、祛风止痛片、祛风舒筋丸、正天丸、右归丸等。含生天南星的中成药（B错）有伤疖膏、如意金黄散等。含马钱子的中成药（C错）：九分散、山药丸、舒筋丸、疏风定痛丸、伤科七味片等。含蟾酥的中成药（D错）：六神丸、六应丸、喉症丸、梅花点舌丸、麝香保心丸、麝香通心滴丸等。含生半夏的中成药（E错）有复方鲜竹沥液、暑湿感冒颗粒、藿香正气口服液、藿香正气水、藿香正气软胶囊、藿香正气丸等。